男，51岁。2天前突发胸背痛，继而双下肢无力、麻木、排尿困难。起病前1周有上呼吸道感染史。既往史无特殊。查体：神清、语利。脑神经检查未见异常。双上肢肌力5级，肌张力正常。双下肢肌力2级，肌张力低，腱反射未引出，病理征阴性。T₄以下针刺觉减退。最可能的诊断是
A. 吉兰巴雷综合征
B. 髓内肿瘤
C. 髓外肿瘤
D. 急性脊髓炎
E. 颈椎病

正确答案：D。急性脊髓炎

解析：急性脊髓炎以胸髓（T3～5）最为常见，多数患者在出现脊髓症状前1～4周有发热、上呼吸道感染、腹泻等病毒感染症状，病变以下感觉、运动丧失，且同时伴有二便障碍。结合该患者的症状、体征，最可能的诊断为急性脊髓炎（D对）。吉兰巴雷综合征患者无排尿、排便障碍（A错）。髓内肿瘤（B错）、髓外肿瘤（C错）大多病情进展缓慢，主要为脊髓压迫症状，表现为根痛或局限性运动障碍，疼痛部位固定、剧烈难忍，痛温觉减退或缺失等。颈椎病主要表现为颈背疼痛、上肢无力、手指发麻、头晕、恶心，甚至视物模糊等症状（E错）。